属于溶液型液体药剂的有
A. 溶液剂
B. 溶胶剂
C. 芳香水剂
D. 醑剂
E. 甘油剂

正确答案：A、C、D、E。溶液剂；芳香水剂；醑剂；甘油剂